男，36岁。2周前发现右下后牙牙龈有小包，平时无明显不适。检查见右下第一磨牙咬合面深龋，穿髓孔探无感觉，叩（±），右下第二磨牙根尖处牙龈有瘘管开口，压挤少许脓液出。X线片见右下第一磨牙近中根尖X线透射区不规则，边界模糊。主诉牙应诊断为
A. 慢性牙髓炎
B. 慢性牙槽脓肿
C. 根尖囊肿
D. 根尖肉芽肿
E. 慢性牙周炎

正确答案：B。慢性牙槽脓肿

解析：本题考查慢性根尖周炎的X线表现。结合病例描述，主诉牙位右下第一磨牙，无明显不适症，深龋，穿髓孔探无感觉，叩（±）,牙龈有瘘管，X线片见右下第一磨牙近中根尖X线透射区不规则，边界模糊，可诊断右下第一磨牙为慢性牙槽脓肿（B对）。慢性牙髓炎（A错）不会有根尖区的骨质破坏。根尖囊肿（C错）的X线片表现为边界清晰，有骨白线包绕。根尖肉芽肿（D错）的X线表现为根尖部圆形透射影，边界清晰。慢性牙周炎（E错）X线表现为牙槽骨的高度降低，即牙槽骨有吸收。